男，65岁。干咳2周入院，无发热咯血及呼吸困难，查体：心肺未见异常，双手可见杵状指，胸部X线片示右下肺可见直径约3cm的类圆形阴影，其内可见小空洞，该患者应首先考虑的诊断是
A. 肺结核
B. 慢性肺脓肿
C. 肺囊肿继发感染
D. 支气管肺癌
E. Wegner肉芽肿

正确答案：D。支气管肺癌

解析：患者为老年男性（为肺癌的好发年龄），干咳2周，无发热咯血及呼吸困难，胸部X线可见右下肺3cm类圆阴影，内有小空洞（为周围型肺癌的典型胸片改变），根据其临床表现和辅助检查，考虑诊断周围型肺癌（D对）。肺结核（A错）有结核中毒症状如低热盗汗、食欲减退等，且咳嗽伴咯血，X线片示病变多发生在上叶的尖后段、下叶的背段和后基底段，呈多态性改变，密度不均匀、边缘较清楚和病变变化较慢，易形成空洞和播散病灶。慢性肺脓肿（B错）感染症状明显，有高热，咳大量脓性痰，听诊有湿啰音。肺囊肿继发感染（C错）会发热明显，听诊可有湿啰音。Wegner肉芽肿（E错）为一种病因不明的血管性、系统性、炎症性疾病，多表现为血管炎，具有多种多样的临床表现。